男性患者，55岁，就诊时面容痛苦，诉右上后牙剧痛不敢咬合轻碰即痛。查见：右上6相对根尖区牙龈肿胀，移行沟变浅，扪诊有深部波动感。右上6叩（+++）松Ⅲ度，可探及髓腔，无反应，右上7牙体完好，颊侧可探及根分叉，无法探入，叩（++）松Ⅲ度。右侧面颊肿胀，触痛。则首先应作处理为
A. 静脉滴注抗生素
B. 切开排脓
C. 去除龋坏组织
D. 调（牙合）
E. A+B

正确答案：E。A+B

解析：本题考查应急处理-切开排脓。根据患牙症状可诊断出右上6为急性根尖周炎骨膜下脓肿，右上7牙冠完好，右侧面颊部肿胀，可见右上7为牙周脓肿，急性根尖周炎的应急处理为切开排脓，急性牙周脓肿的治疗原则是止痛、防止感染扩散以及使脓液引流。一般可采用口服或注射的途径给予抗生素类药物或止痛药物，所以首先应作处理为静脉滴注抗生素+切开排脓（E对）。